可以用于久痹体虚，关节疼痛，局部肿大，屈伸不利，还有风湿性关节炎的非处方药是
A. 天麻丸
B. 尪痹颗粒
C. 活血止痛散
D. 舒筋活络丸
E. 云南白药酊

正确答案：B。尪痹颗粒

解析：本题考查尪痹颗粒的主治。可以用于久痹体虚，关节疼痛，局部肿大，屈伸不利，还有风湿性关节炎的非处方药是尪痹颗粒（B对）。尪痹颗粒（片）【主治】肝肾不足、风湿痹阻所致的尪痹，症见肌肉、关节疼痛，局部肿大，僵硬畸形，屈伸不利，腰膝酸软，畏寒乏力；类风湿关节炎见上述证候者。天麻丸（A错）（片）【主治】风湿瘀阻、肝肾不足所致的痹病，症见肢体拘挛、手足麻木、腰腿酸痛。活血止痛散（C错）（胶囊、片）【主治】跌打损伤，瘀血肿痛。舒筋活络丸（D错）【主治】用于一般骨节风痛，腰膝酸痛。云南白药酊（E错）【主治】跌打损伤，瘀血肿痛，吐血，咳血，便血，痔血，崩漏下血，疮疡肿毒及软组织挫伤，闭合性骨折，支气管扩张及肺结核咳血，溃疡病出血，以及皮肤感染性疾病。